临床哪项检查对判断霍乱脱水程度最有意义
A. 皮肤黏膜弹性
B. 血压
C. 血细胞比容
D. 血钠
E. 血浆比重

正确答案：E。血浆比重

解析：霍乱轻度脱水者约失水1000mL（儿童70～80mL/kg）；中度脱水者约失水3000～3500mL（儿童80-100mk/kg）；重度脱水者约失水4000mL（儿童100～120mL/kg）。脱水程度可根据血浆比重等判断（E对）。